可抑制胎儿、婴幼儿骨骼发育的是
A. 氯霉素
B. 青霉素
C. 四环素
D. 米诺环素
E. 多西环素

正确答案：C。四环素

解析：四环素类药物与新形成的骨骼和牙齿中沉积的钙离子结合，造成恒齿永久性棕色色素沉着（俗称牙齿黄染），还可抑制胎儿、婴幼儿骨骼发育。掌握“四环素、多西环素及米诺环素”知识点。